男，56岁。反复上腹痛10年余，加重3个月，伴乏力。查体：结膜苍白，上腹部轻压痛。下列检查中，对明确诊断及指导治疗最有价值的是
A. X线上消化道造影
B. 胃镜及活检
C. 腹部B型超声
D. 腹部CT
E. 血清肿瘤标志物

正确答案：B。胃镜及活检

解析：老年男性患者，有10余年上腹痛病史（考虑慢性胃炎或消化性溃疡），3月来腹痛加重（上腹痛规律改变），并伴有乏力症状。查体：结膜苍白（贫血症状），上腹部轻压痛（胃癌进展期上腹部有轻压痛）。综合患者病史和查体，考虑诊断为胃癌，对明确诊断及指导治疗最有价值的是胃镜及活检（B对）。X线钡餐（A错）可发现胃内溃疡（呈龛影）及隆起的病灶（呈充盈缺损），但难以鉴别其良恶性（P366），故不能用于确诊胃癌。腹部B型超声（C错）容易受到胃内气体干扰，不用于诊断胃部疾病。腹部CT（D错）检查对评价胃癌的病变范围、局部淋巴结转移和远处转移等方面具有较高的价值，可用于胃癌术前临床分期，但在确诊胃癌方面不如胃镜结合活检可靠。血清肿瘤标记物（E错）在部分胃癌病人中可见升高，但目前仅作为判断预后和治疗效果的指标。